脂肪动员的关键酶是
A. 脂蛋白脂肪酶
B. 甘油一酯酶
C. 甘油二酯酶
D. 甘油三酯酶
E. 激素敏感性甘油三酯酶

正确答案：E。激素敏感性甘油三酯酶